封闭疗法用2%利多卡因2～3ml行翼外肌封闭
A. 翼外肌功能亢进
B. 翼外肌痉挛
C. 不可复性关节盘移位
D. 可复性关节盘移位
E. 肌筋膜痛

正确答案：B。翼外肌痉挛

解析：翼外肌痉挛：解除肌痉挛，治疗方法包括理疗（15%氯化钙溶液作关节区及咀嚼肌区离子导入）、红外线、激光等；封闭疗法（2%利多卡因2～3ml行翼外肌封闭）；中药局部热敷等。掌握“颞下颌关节紊乱”知识点。